糖皮质激素升高血糖的机制是
A. 减少糖异生
B. 抑制肝外组织的葡萄糖利用
C. 促进糖类转变为脂肪
D. 促进脂酸合成
E. 促进葡萄糖氧化

正确答案：B。抑制肝外组织的葡萄糖利用

解析：糖皮质激素是调节机体糖代谢的重要激素之一，可以升高血糖。其作用机制是（1）促进糖原异生（A错），特别是利用肌肉蛋白质代谢中的一些氨基酸及其中间代谢产物作为原料合成糖原。（2）减少机体组织对葡萄糖的利用（B对），同时增加中间代谢产物如丙酮酸和乳酸等在肝脏和肾脏再合成葡萄糖，增加血糖来源。促进糖类转变为脂肪（C错）、促进脂酸合成（D错）、促进葡萄糖氧化（E错）都是降低降低血糖的机制。